加有肾上腺素的局部麻醉药不能用于
A. 儿童
B. 月经期妇女
C. 血小板减少的患者
D. 健康老年人
E. 心律失常患者

正确答案：E。心律失常患者

解析：本题考查局麻药中的血管收缩剂。肾上腺素是血管收缩剂，由于肾上腺素可引起心悸、头痛、紧张、恐惧、颤抖及失眠，如用量过大或注射时误入血管，血内肾上腺素浓度上升时，可因血压骤升而发生脑出血；或因心脏过度兴奋引起心律失常，甚至心室纤颤等不良反应。因此临床上应严格限制麻药中的肾上腺素浓度和加有肾上腺素的局部麻醉药不能用于心律失常患者（E错，为本题的正确答案）。肾上腺素等血管收缩剂加入局麻药中，可延缓吸收，降低毒性反应，延长麻醉时间，减少注射部位的出血，儿童（A对）、月经期妇女（B对）、血小板减少的患者（C对）、健康老年人（D对）等人在严格限制使用浓度和一次性注射量的情况下可以使用。